固定桥的优点不包括
A. 稳定、固位、支持良好，能充分恢复因缺牙而丧失的部分咀嚼功能
B. 与原牙列中的同名牙大小和外形相似，无异物感，不影响舌的功能活动
C. 磨除牙体组织多，适用范围小
D. 美观性高
E. （牙合）力由桥基牙分担承受

正确答案：C。磨除牙体组织多，适用范围小

解析：本题考查固定桥的优点。固定桥的基牙预备时，磨除牙体组织多，且适用范围小（C错，为本题的正确答案），此为固定桥修复的一个显著缺点。固定桥靠粘固剂、粘接剂或固定装置与缺牙两侧预备好的基牙或种植体连接在一起，稳定、固位、支持良好，能充分恢复因缺牙而丧失的部分咀嚼功能（A对）。固定桥由固位体、桥体、连接体三部分组成，恢复缺失牙的解剖形态和生理功能，与原牙列中的同名牙大小和外形相似，无异物感，不影响舌的功能活动（B对）。固定桥由于不需要金属卡环等固位，美观性高（D对），适用于前牙美学修复。由于固位体、桥体和连接体之间常为固定连接，有利于使（牙合）力由桥基牙分担承受（E对），避免因个别基牙受力过大而出现的基牙损伤。